一般选用临时冠的修复为
A. 嵌体
B. 部分冠
C. 桩核冠
D. 塑料全冠
E. 铸造金属全冠

正确答案：D。塑料全冠

解析：本题考查牙体缺损修复体固位及适应、禁忌证。塑料全冠（D对）适用于暂时修复，也成临时冠，主要用于保护活髓牙体。